固定桥倾斜牙作基牙，如患者年轻，首选的方法是
A. 直接预备
B. 失活倾斜牙，大量磨改
C. 作单端固定桥
D. 作半固定桥
E. 正畸后再修复

正确答案：E。正畸后再修复

解析：轻度倾斜牙齿可以选作基牙，如果在条件允许情况下，最好经过正畸治疗改正牙位，或适当加大牙体预备量以取得共同就位道。掌握“固定桥的生理基础”知识点。